女，28岁，工人。发热、干咳1个月。发病时胸部X线片提示肺纹理增多，先后使用“青霉素”、“头孢菌素”抗感染治疗半月余症状未见好转。查体：T39.8℃，消瘦，双侧颈部可触及多个成串小淋巴结，双肺未闻及干湿啰音。PPD试验（-），胸部X线片示双肺弥漫分布直径约2mm的小结节影。该患者最可能的诊断是
A. 真菌性肺炎
B. 病毒性肺炎
C. 过敏性肺炎
D. 急性粟粒性肺结核
E. 细菌性肺炎

正确答案：D。急性粟粒性肺结核

解析：患者为青年女性，发热、干咳1个月，“青霉素”、“头孢菌素”抗感染治疗无效（抗生素对肺结核无效），患者消瘦，双侧颈部可触及淋巴结，且X线胸片示双肺弥漫分布直径约2mm的小结节影（为急性粟粒性肺结核典型的胸片改变），根据其临床表现和辅助检查，考虑诊断为急性粟粒性肺结核。PPD实验阴性，可发生在全身情况较差的结核病患者，特别是粟粒型肺结核的患者（D对）（PPD试验阳性，仅对于未接种过卡介苗的婴幼儿和儿童结核病患者有诊断性意义）。真菌性肺炎（P54）（A错）常继发于大量使用广谱抗生素、糖皮质激素后出现，X线影像表现无特异性，可为支气管肺炎、大叶性肺炎、单发或多发结节，乃至肿块状阴影和空洞。病毒性肺炎及过敏性肺炎（BC错）可有发热、咳嗽等症状，但X线胸片不会出现双肺弥漫分布的小结节影。细菌性肺炎（E错）用抗生素治疗有效，胸片不会出现弥漫分布直径约2mm的小结节影。